关于外科打结的形态要求叙述不正确的是
A. 根据结的形态，临床可分为单结、方结、三重结或多重结、外科结、假结和滑结等
B. 口腔颌面外科手术中的打结可以打方结
C. 口腔颌面外科手术中的打结可以打滑结
D. 口腔颌面外科手术中的打结可以打外科结
E. 高质量的打结是防止返工和术后脱结出血的保证

正确答案：C。口腔颌面外科手术中的打结可以打滑结

解析：根据结的形态，临床上可分为单结、方结、三重结或多重结、外科结、假结和滑结等。口腔颌面外科手术中的打结与其他外科手术打结一样，要求打方结、外科结，防止打滑结，以保证质量，避免返工重打和术后脱结出血。掌握“口外手术打结、缝合及外科引流”知识点。